我国颁布的“母婴保健法”规定在新生儿期进行筛查的遗传代谢内分泌疾病是
A. 21-三体综合征，苯丙酮尿症
B. 先天性甲状腺功能减低症，苯丙酮尿症
C. 先天性甲状腺功能减低症，21-三体综合征
D. 先天性甲状腺功能减低症，半乳糖血症
E. 21-三体综合征，半乳糖血症

正确答案：B。先天性甲状腺功能减低症，苯丙酮尿症

解析：我国颁布的“母婴保健法”规定在新生儿期进行筛查的遗传代谢内分泌疾病是先天性甲状腺功能减低症，苯丙酮尿症（B对）。